保守患者的秘密，其实质是（或体现了什么原则）
A. 尊重患者自主
B. 不伤害患者自尊
C. 保护患者者隐私
D. 医患双方平等
E. 人权高于一切

正确答案：A。尊重患者自主